白芥子善治
A. 肺热咳嗽
B. 风痰眩晕
C. 悬饮胁痛
D. 痰热结胸
E. 中风痰厥

正确答案：C。悬饮胁痛

解析：本题考查芥子的主治病证。白芥子善治悬饮肋痛（C对）。芥子【主治病证】（1）寒痰咳喘，悬饮胁痛。（2）痰阻经络之肢体关节疼痛，阴疽流注。车前子【主治病证】（1）湿热淋证，小便不利，水肿兼热。（2）暑湿水泻。（3）肝热目赤肿痛，肝肾亏虚之目暗不明（配补肝肾药）。（4）肺热咳嗽（A错）痰多。天南星【主治病证】（1）顽痰咳嗽。（2）风痰眩晕（B错），中风口眼㖞斜，癫痫，破伤风。（3）痈疽肿痛，瘰疬痰核。葶苈子治痰热结胸（D错），饮停胸胁，常与苦杏仁、大黄、芒硝等同用，如大陷胸丸（《伤寒论》）。麝香【主治病证】（1）热病神昏，中风痰厥（E错），气郁暴厥，中恶神昏。（2）闭经，癞瘕，难产死胎。（3）胸痹心痛，心腹暴痛，痹痛麻木，跌打损伤。（4）疮肿，瘰疬，咽喉肿痛。